男性，65岁。近2年来右上肢抖动，动作迟缓面容呆板，行走起步困难，查体右上下肢肌张力增高，齿轮样动作。该患者可用下列哪些药物治疗
A. 左旋多巴
B. 泼尼松
C. 地西泮
D. 甲基多巴肼
E. 吡啶斯的明

正确答案：A。左旋多巴